33岁经产妇，平时月经周期稍缩短，经量多。检查宫颈糜烂Ⅱ°，宫口松，最合适的避孕方法应是
A. 安全期避孕
B. 阴茎套避孕
C. 阴道隔膜避孕
D. 宫内节育器避孕
E. 口服避孕药避孕

正确答案：E。口服避孕药避孕

解析：患者为青年经产妇，避孕方式选择的原则为：选择长效、安全、可靠的避孕方法，减少非意愿妊娠进行手术带来的痛苦。各种避孕方法（宫内节育器、皮下埋植剂、复方口服避孕药、避孕针、阴茎套等）均适用，根据个人身体状况进行选择。患者平时月经周期缩短（黄体功能不足表现为月经周期缩短），经量多，考虑为黄体功能不足。治疗选口服避孕药（E对），且此法尤其适用于有避孕要求的患者。患者妇检宫颈糜烂Ⅱ°，研究表明阴茎套与宫颈糜烂的发生有关，且能加重其进展，故不宜选择阴茎套避孕（B错）。宫内节育器避孕（D错）不宜用于宫颈内口过松、重度陈旧性宫颈裂伤或子宫脱垂。阴道隔膜（P381）（C错）又称女用避孕套，目前我国尚无供应。安全期避孕法（P381）（A错）不可靠，不宜推广。